中药品种保护审评委员会做出审评结论的时间是
A. 6个月以内
B. 一年以内
C. 5年
D. 7年
E. 分别为30年、20年、10年

正确答案：A。6个月以内

解析：本题考查中药保护品种的保护措施。中药品种保护审评委员会做出审评结论的时间是6个月以内（A对）。对批准保护的品种，国家局将在政府网站和《中国医药报》上予以公告。生产该品种的其他生产企业应自公告发布之日起6个月内向局受理中心提出同品种保护申请并提交完整资料；对逾期提出申请的，局受理中心将不予受理。申请延长保护期的生产企业，应当在该品种保护期届满前6个月前向局受理中心提出申请并提交完整材料。综合以上中药品种保护指导原则，可知中药品种保护审评委员会做出审评结论的时间是6个月。